味苦，性微寒，善治阳黄、阴黄与湿疹瘙痒的药是
A. 金钱草
B. 海金沙
C. 连钱草
D. 萆薢
E. 茵陈

正确答案：E。茵陈

解析：本题考查的是茵陈的性能特点。味苦，性微寒，善治阳黄、阴黄与湿疹瘙痒的药是茵陈（E对）。茵陈：【性能特点】本品苦微寒清利，气清香疏理，入脾、胃与肝、胆经。善清利湿热而退黄，为治黄疸之要药，无论阳黄、阴黄皆宜。兼止痒，治湿疮、湿疹瘙痒。金钱草（A错）：【性能特点】本品甘淡渗利，咸软入肾，微寒能清。入肝、胆经，清利肝胆而退黄、排石；入肾与膀胱经，清热利尿而善通淋、排石；还能清热解毒而消肿疗疮。为治湿热黄疸、肝胆结石、石淋之佳品，且能清热解毒而消肿疗疮，为治疮肿、蛇伤所常用。海金沙（B错）：【性能特点】本品甘淡渗利，寒能清泄，入膀胱与小肠经。善通淋、止痛，并兼排石，为治淋证涩痛之要药，治血淋、石淋常用，兼尿道涩痛者尤佳。连钱草（C错）：【性能特点】本品辛微苦散泄，微寒能清，入肝、肾、膀胱经。既清利湿热而通淋、退黄，治石淋最宜，治黄疸可选；又清热解毒而疗疮肿，散瘀消肿而治伤痛。萆薢（D错）：【性能特点】本品苦能泄降，平而不偏，入肝、胃与膀胱经。既除下焦之湿而分清祛浊，为治膏淋、白浊及湿盛带下之要药；又祛筋骨、肌肉之风湿而通痹止痛，为治风湿痹痛之佳品。